下列关于小儿捏脊疗法操作程序的叙述，错误的是
A. 患儿俯卧，医生两手半握拳，两食指抵于背脊之上
B. 两手拇指仲向食指前方，合力夹住肌肉提起
C. 接着拇指向前，食指向后退，作翻卷动作
D. 自长强穴起，捏到大椎穴止，反复5次
E. 捏第3次起，每捏3把，将皮肤提起1次

正确答案：C。接着拇指向前，食指向后退，作翻卷动作

解析：拇指向前，食指向后退，无法提拿皮肉（C错，为本题正确答案）。捏脊法是用双手的中指、无名指和小指握成半拳状，食指半屈，拇指伸直对准食指前半段，然后顶住患儿皮肤，拇、食指前移，提拿皮肉（AB对）。自尾椎长强穴两旁双手交替向前，推动至大椎两旁，算作捏脊一遍，反复5次可治疳证（D对）。捏第3次起，每捏3把，将皮肤提起1次，可加强刺激（E对）。